固冲汤除固冲摄血外，还具有的功用是
A. 补肾涩精
B. 补气健脾
C. 补气生血
D. 温补脾肾
E. 温经止痛

正确答案：B。补气健脾

解析：该题考查固冲汤的功用。固冲汤功能固冲摄血，益气健脾，主治因肾虚不固，脾虚不摄，冲脉滑脱所致的脾肾亏虚，冲脉不固证（B对）。趣记：固冲汤，总数齐，海龙母鱼要千倍——棕术芪，海龙牡萸药茜倍。